属于《贝尔蒙报告保护人类受试者的伦理原则与准则》1979年的内容的是
A. 提供已确定的有效治疗作为对照
B. 区分医疗与研究之间的界限
C. 研究人员机构与商业实体有权利获得公平回报
D. 科技必须考虑公共利益
E. 应该保护个人家庭与社群，防止歧视和侮辱

正确答案：B。区分医疗与研究之间的界限

解析：《贝尔蒙报告》提出了区分生物医学和行为学研究与常规认可的行医是很重要的（B对）。《国际性研究中的伦理与政策问题：发展中国家的临床试验》2001的内容的是：①对临床实验伦理行动的基本要求②提供已确定的有效治疗作为对照。③公平对待和尊重参加者。④获得试验后利益。⑤在国际性临床试验中确保保护参加者（A错）。《国际人类基因组组织伦理委员会关于人类基因组数据库的声明（2002年）》建议提出研究人员机构与商业实体有权获得公平回报（C错）。并于2003 年修订推出《人类辅助生殖技术规范》《人类精子库基本标准和技术规范》《人类辅助生殖技术和人类精子库伦理原则》提出科技必须考虑公共利益（D错）。《国际人类基因组组织伦理委员会关于人类基因组数据库的声明（2002年）》建议提出应该保护个人家庭与社群防止歧视和侮辱（E错）。